地方性甲状腺肿的好发年龄是
A. 0～10岁
B. 15～20岁
C. 25～35岁
D. 40～50岁
E. 55～65岁

正确答案：B。15～20岁

解析：本题考查地方性甲状腺肿的好发年龄。地方性甲状腺肿是一种主要由于地区性环境缺碘引起的地方病，是碘缺乏病的主要表现形式之一。其好发年龄是15～20岁（B对ACDE错）。